β肾上腺素受体阻断药能与激动药可呈典型的
A. 非竞争性拮抗
B. 激动去甲肾上腺素能受体
C. 强化肾上腺素受体
D. 竞争性拮抗
E. 激动胆碱能受体

正确答案：D。竞争性拮抗

解析：β肾上腺素受体阻断药能与去甲肾上腺素能神经递质或肾上腺素受体激动药竞争β受体，从而拮抗其β型拟肾上腺素作用。它们与激动药呈典型的竞争性拮抗。掌握“β肾上腺素受体阻断剂”知识点。